下面哪项不是引起低钙血症的病因？
A. 肝硬化
B. 慢性肾功能衰竭
C. 高镁血症
D. 甲状旁腺功能减退
E. 急性胰腺炎

正确答案：C。高镁血症

解析：维生素D促进钙的吸收，肝硬化（A对）时维生素D羟化障碍，钙吸收减少，引起低钙血症。慢性肾功能衰竭（B对）时肾实质破坏，1，25-（0H）2D3生成不足，肠钙吸收减少，导致低钙血症。镁缺乏使甲状旁腺分泌PTH减少，同时靶器官对PTH的反应性减弱，肠道吸收钙、肾小管重吸收钙和骨钙动员均发生障碍，导致血钙浓度降低，高镁血症不是引起低钙血症的病因（C错，为本题正确答案）。PTH能通过促进成骨和溶骨的双重作用、增加肾近曲小管、远曲小管和髓袢上升段对Ca2＋的重吸收、促进小肠吸收钙升高血钙，甲状旁腺功能减退（D对）时引起低钙血症。急性胰腺炎（E对）时机体对PTH的反应性降低，同时钙可与胰腺炎症和坏死释放出的脂肪酸结合形成难以被肠吸收的钙皂而致低钙血症。